对待患者一视同仁，在医疗资源分配等问题上公平公正的医学道德品质是
A. 仁慈
B. 严谨
C. 诚实
D. 公正
E. 奉献

正确答案：D。公正

解析：医者的职业美德中反映对待患者一视同仁，在医疗资源分配等问题上公平公正的是公正（D对）。